乳牙患龋率最高的牙位
A. 上颌乳磨牙
B. 下颌乳磨牙
C. 上颌乳切牙
D. 上颌乳尖牙
E. 下颌乳前牙

正确答案：B。下颌乳磨牙

解析：本题考查龋病的好发牙位。乳牙患龋率最高的牙位是下颌乳磨牙（B对）。乳牙患龋的好发牙位依次为下颌乳磨牙、上颌乳磨牙（A错）、上颌乳前牙（CD错）、下颌乳前牙（E错）。